聚酰胺吸附法分离物质的根据
A. 物质氢键吸附强弱的差别
B. 物质分子大小的差异
C. 物质在两相溶剂中分配比的差别
D. 物质的解离程度的差别
E. 物质折光率大小的差别

正确答案：A。物质氢键吸附强弱的差别

解析：本题考查聚酰胺吸附法的原理。聚酰胺吸附法分离物质的根据物质氢键吸附强弱的差别（A对）。聚酰胺色谱的分离机理一般认为是“氢键吸附”，即聚酰胺的吸附作用是通过其酰胺羰基与黄酮类化合物分子上的酚羟基形成氢键缔合而产生的，其吸附强度主要取决于黄酮类化合物分子中酚羟基的数目与位置等，及溶剂与黄酮类化合物或与聚酰胺之间形成氢键缔合能力的大小。凝胶色谱法：凝胶色谱法也称凝胶过滤法、凝胶渗透色谱、分子筛过滤或排阻色谱，是根据物质分子大小差别（B错）进行分离。根据物质在两相溶剂中的分配比不同（C错）进行分离，例如，液-液萃取法、pH萃取法、柱色谱法等。离子色谱法：离子色谱法是根据物质解离程度的不同（D错）进行分离。物理常数相：对密度、比旋度、折光率（E错）及沸点等是鉴定挥发油常用的物理常数。